下列符合化妆品管理要求的是
A. 特殊化妆品需经省级以上药品监督管理部门注册后方可生产、进口和经营
B. 国产普通化妆品在上市销售后，向所在地省级药品监督管理部门备案
C. 国家按照风险程度对化妆品、化妆品原料实行分类管理
D. 已经注册的特殊化妆品在生产工艺、功效宣称等方面发生任何变化，注册人均应当向原注册部申请变更注册

正确答案：C。国家按照风险程度对化妆品、化妆品原料实行分类管理

解析：本题考查化妆品的界定和分类。下列符合化妆品管理要求的是国家按照风险程度对化妆品、化妆品原料实行分类管理（C对）。特殊化妆品经国务院药品监督管理部门注册后方可生产、进口（A错）。国产普通化妆品应当在上市销售前向备案人所在地省、自治区、直辖市人民政府药品监督管理部门备案（B错）。已经注册的特殊化妆品在生产工艺、功效宣称等方面发生实质性变化的，注册人应当向原注册部门申请变更注册（D错）。